牙髓电活力测试可能出现假性反应，引起假阳性反应的原因不包括下列哪一项
A. 探头或电极接触大面积的金属修复体或牙龈，使电流流向牙周组织。
B. 未充分隔湿或干燥受试牙，以致电流泄漏到牙周组织。
C. 液化坏死的牙髓有可能传导电流至根尖周，当电流调节到最大刻度时，患者可能有轻微反应
D. 患者过度紧张和焦虑，以致在探头刚接触牙面或被问知感受时即示意有反应。
E. 患者事先用过镇痛剂、麻醉剂或酒精饮料等，不能正常地感知电刺激。

正确答案：E。患者事先用过镇痛剂、麻醉剂或酒精饮料等，不能正常地感知电刺激。

解析：本题考查假阳性反应的原因。牙髓电活力测试可能出现假性反应，引起假阳性反应的原因不包括患者事先用过镇痛剂、麻醉剂或酒精饮料等，不能正常地感知电刺激（E错，为本题正确答案）。患者事先用过镇痛剂、麻醉剂或酒精饮料等，使之不能正常地感知电刺激，可出现假阴性反应。假阳性反应的原因：（1）探头或电极解除了大面积的金属修复体或牙龈，使电流流向了牙周组织（A对）。（2）未充分隔湿或干燥被测牙，以致电流泄露至牙周组织（B对）。（3）液化性坏死的牙髓有可能传导至根尖周组织，当电流调节到最大刻度时，患者可能会有轻微反应（C对）。（4）患者过度紧张和焦虑，以致在探头刚接触牙面或被问及感受时即示意有反应（D对）。